急性根尖周炎最常见的排脓途径
A. 经龋洞排脓
B. 深的牙周袋排脓
C. 经黏膜、皮肤排脓
D. 可通过上颌窦排脓
E. 可通过耳道排脓

正确答案：C。经黏膜、皮肤排脓

解析：本题考查急慢性根尖周炎。化脓性根尖周炎最常见的排脓途径是经黏膜、皮肤排脓（C对），即通过根尖区骨松质到达牙槽骨的骨外板，经外板的哈弗管到达骨膜下形成骨膜下脓肿。